交感神经过度兴奋引起的窦性心动过速最好选用
A. 普萘洛尔
B. 胺碘酮
C. 苯妥英钠
D. 普鲁卡因胺
E. 美西律

正确答案：A。普萘洛尔

解析：交感活动加强时，儿茶酚胺释放增多，可加快窦房结4相除极速度和异位起搏速率，普萘洛尔（A对）能阻断窦房结β受体，防止交感活动对4相除极和异位起搏的影响，降低自律性，适用于交感神经过度兴奋引起的窦性心动过速。胺碘酮（B错）为广谱抗心律失常药，对各型期前收缩、室上性心动过速、房扑等有效，为治疗冠心病等器质性心脏病或心功能不全伴潜在恶性或恶性快速型心律失常的最常用药物。苯妥英钠（C错）主要用于治疗室性心律失常，特别对强心苷中毒引起的室性心律失常有效，亦用于心肌梗死、心脏手术、心导管术等引发的室性心律失常。普鲁卡因胺（D错）属于广谱抗心律失常药，临床主要用于室性心律失常，可用作奎尼丁的替换要，静脉滴注或注射可用于抢救危急病例。美西律（E错）电生理作用和药理作用与利多卡因相似，属于窄谱抗心律失常药，特别对心肌梗死和洋地黄中毒引起的心律失常有效。